感染伤口的处理原则应为
A. 清创后一期缝合
B. 清创后延期缝合
C. 清创后不予缝合
D. 加强换药
E. 使用大量抗菌药物

正确答案：D。加强换药

解析：本题考查创伤和战伤。感染伤口先要引流，加强换药（D对），然后再做其他处理。